胎膜早破诊断常用检查方法及处理错误的是
A. 阴道液酸碱度检查
B. 阴道液涂片检查
C. 羊膜镜检查
D. 羊水涂片检查
E. 终止妊娠

正确答案：D。羊水涂片检查

解析：胎膜早破诊断常用的辅助检查有：1.阴道酸碱度检查。PH≥6.5，提示胎膜早破；2.阴道液涂片检查。阴道液置于载玻片上，干燥后镜检可见羊齿植物叶状结晶，用0.5%硫酸尼罗蓝染色，镜下见橘黄色胎儿上皮细胞，用苏丹Ⅲ染色见黄色脂肪小粒，均可确定为羊水；3.羊膜镜检查，看不到前羊膜囊，可直视胎儿先露部，即可诊断；4.B型超声检查，羊水量减少可协助诊断。胎膜早破的治疗可分为1.期待疗法：适用于妊娠28～35周、胎膜早破不伴感染，羊水平段≥3cm者；2.终止妊娠：妊娠35周后，胎肺成熟，宫颈成熟，无禁忌证可经阴道分娩。若胎头高浮，胎位异常，宫颈不成熟，胎肺成熟，明显羊膜腔感染，伴有胎儿窘迫，抗感染同时行剖宫产术终止妊娠，作好新生儿复苏准备（D错，为本题正确答案）。